瞳孔散大是因为损伤了
A. 视神经
B. 迷走神经
C. 动眼神经
D. 三叉神经
E. 交感神经

正确答案：C。动眼神经

解析：视神经（A错）损伤导致瞳孔对光反射消失。迷走神经（B错）主干损伤后，表现为脉速、心悸、恶心、呕吐、呼吸深慢和窒息等症状。由于咽喉感觉障碍和肌肉瘫痪，可出现声音嘶哑、语言和吞咽困难，腭垂偏向一侧等症状。动眼神经支配瞳孔开大肌和瞳孔括约肌，一侧动眼神经（C对）损伤，可致瞳孔斜向外下方及瞳孔扩大。一侧三叉神经（D错）损伤，表现为神经损伤侧面部皮肤以及口、鼻腔黏膜感觉障碍，角膜反射消失，咀嚼肌瘫痪。交感神经（E错）属于内脏运动神经。